28岁经产妇，人工流产术后半年，术后断续阴道流血，量不多，术后一直避孕。尿妊娠试验阳性，查子宫如鸭卵大小。胸片见两肺中下部有多处散在棉絮团影。本例最可能的疾病是
A. 吸宫不全
B. 葡萄胎
C. 侵蚀性葡萄胎
D. 绒毛膜癌
E. 胎盘部位滋养细胞肿瘤

正确答案：D。绒毛膜癌

解析：该患者为年轻经产妇，人工流产术后（非葡萄胎妊娠后只继发绒癌）断续阴道流血，尿妊娠实验阳性（人工流产术后30天hCG可恢复正常），妇检子宫大且软。胸片见两肺中下部有多处散在棉絮团影（典型表现为棉球状或团块状阴影。转移灶以右侧肺及中下部较为多见），最可能的疾病是绒毛膜癌（D对）。侵袭性葡萄胎（P338）（C错）全部继发于葡萄胎妊娠。吸宫不全（P384）（A错）指人工流产术后部分妊娠组织物的残留。表现为术后阴道流血时间长，血量多或流血停止后再现多量流血。葡萄胎（P336）（B错）典型表现为停经后不规则阴道流血、子宫大于停经月份，而不是人流半年后阴道流血。胎盘部位滋养细胞肿瘤（P343）（E错）是指起源于胎盘种植部位的一种特殊类型的滋养细胞肿瘤。临床罕见，多数不发生转移，预后良好。